关于心脏外形的描述，错误的是
A. 略似倒置的圆锥体
B. 左右略扁，周围裹以心包
C. 心尖朝向左前下方
D. 心底朝向右后上方
E. 大小与本人拳头类似

正确答案：B。左右略扁，周围裹以心包

解析：心脏形似倒置的（A对）、前后稍扁（B错，为本题正确答案）的圆锥体，周围裹以心包。心尖朝向左前下方（C对）。心底朝向右后上方（D对）。大小与本人拳头类似（E对）。